以下不属于头颈部环形组淋巴结群的是
A. 锁骨上淋巴结
B. 耳后淋巴结
C. 腮腺淋巴
D. 面淋巴结
E. 颏下淋巴结

正确答案：A。锁骨上淋巴结

解析：环形组淋巴结群主要指从枕部、耳周、下颌下到颏下的区域淋巴结群，由后向前环绕头颈部交界处排列，包括枕淋巴结、耳后淋巴结、腮腺淋巴结、面淋巴结、下颌下淋巴结及颏下淋巴结。锁骨上淋巴结为纵形组淋巴结群。掌握“头颈部淋巴的分组”知识点。